某地为了解人群高血压流行情况，拟进行一次普查，根据调查结果可分析
A. 发病率
B. 罹患率
C. 患病率
D. 累积发病率
E. 死亡率

正确答案：C。患病率

解析：本题考查患病率的应用。患病率（C对ABDE错）通常用来表示病程较长的慢性病的发生或流行情况，如高血压、冠心病等。